某医生为评价某新药对流感的治疗效果，共收治了100例流感病人，一周后治愈的有90例，由此认为该新药对流感疗效显著。针对此实验，正确的观点是
A. 结论正确，因为治愈率达90%
B. 结论不能肯定，因为未作重复试验
C. 结论不能肯定，因为未设对照组
D. 结论不能肯定，因为未作统计学处理
E. 结论不能肯定，因为实验样本含量较少

正确答案：C。结论不能肯定，因为未设对照组

解析：试验设计的原则要求必须有对照原则，本题只有试验组，未设置对照组结果不能肯定（A错C对）。此实验共收治了100例患者，符合重复原则（BE错），且治愈90例作出了统计学处理（D错）。